男性，50岁，咳嗽伴声音嘶哑3个月，右锁骨上窝触及一个肿大的淋巴结，质硬、无压痛。提示该患者的诊断可能是
A. 喉炎
B. 肺癌
C. 胃癌
D. 鼻咽癌
E. 肺结核

正确答案：B。肺癌